住院患者的最低生理需要
A. 生存的需要
B. 安全的需要
C. 归属与爱的需要
D. 尊重的需要
E. 自我实现的需要

正确答案：A。生存的需要

解析：在个体生存中，生理的需要是必不可少的，它具有自我和种族保存的意义，其中主要的是饥饿和渴的需要(A对)。安全的需要 当人的生理需要获得一定程度满足之后，随之便产生新的需要，即安全的需要（包括对生命安全、财产安全、职业安全和心理安全的需要），以求免受威胁、免于孤独、免受别人的侵犯。当这一需要获得满足之后，才会有安全感（B错）。归属和爱的需要随着上述需要获得满足后，人类就会产生进一步的社会性的需要：归属和爱的需要。归属的需要就是参加一定的组织，依附于某个团体等。爱的需要包括接受他人和给予他人爱的需求（C错）。尊重的需要 尊重的需要是个体对自身价值的认同。前三个层次的需要获得满足后，尊重的需要才会充分地发展起来。尊重的需要包括自我尊重和他人尊重两个方面。尊重的需要包括渴望实力，获得成就，独立和自由以及渴望名誉或声望，希望受到他人的尊重，受人赏识两个部分（D错）。自我实现的需要在前四种需要获得满足的基础上产生的最高层次的需要。指个体的潜能 和天赋得到充分的发挥（E错）。